与治疗目的无关的对病人不利的反应
A. 交叉耐受性
B. 不良反应
C. 耐受性
D. 抗药性
E. 躯体依赖性

正确答案：B。不良反应

解析：本题考查药品不良反应。与治疗目的无关的对病人不利的反应是不良反应（B对）。药物不良反应（ADR）是指不符合用药目的并给患者带来不适或痛苦的反应。交叉耐受性（A错）是指人体对某药产生耐受性后，亦可能表现出对其他化学结构类似或作用机制类似的同类药物敏感性降低。耐受性（C错）是指在连续用药过程中，有的药物的药效会逐渐减弱，需加大剂量才能显效的现象。抗药性（D错）一般指耐药性，系指在化学治疗中，病原体或肿瘤细胞对化疗药物的敏感性降低的现象。躯体依赖性（E错）是由于反复用药造成身体适应状态产生欣快感，一旦中断用药，可出现强烈的戒断综合征。如镇痛药吗啡、哌替啶，毒品海洛因等应用后，均可引起躯体依赖性和精神依赖性。